下列药品可存放于毒性药品专库的有
A. 美施康定
B. 氢溴酸后马托品
C. 苯酚
D. 阿托品
E. 升汞

正确答案：B、D、E。氢溴酸后马托品；阿托品；升汞

解析：本题考查毒性药品。可存放于毒性药品专库的有：氢溴酸后马托品（B对）、阿托品（D对）、升汞（E对）。毒性药品是指毒性剧烈，治疗剂量与中毒剂量相近，使用不当致人中毒或死亡的药品。毒性药品西药品种共13种：去乙酰毛花苷丙、阿托品、洋地黄毒苷、氢溴酸后马托品、三氧化二砷、毛果芸香碱、升汞、水杨酸毒扁豆碱、氢溴酸东莨菪碱、亚砷酸钾、士的宁、亚砷酸注射液、A型肉毒毒素及其制剂。美施康定（A错）为强效中枢性镇痛药，主要用于晚期癌症患者第三阶梯止痛，不属于毒性药品。苯酚（C错）是生产某些树脂、杀菌剂、防腐剂以及药物（如阿司匹林）的重要原料。